下列哪项不是瘢痕性类天疱疮的临床表现
A. 皮肤水疱
B. 小口畸形
C. 剥脱性龈炎
D. 尼氏征阳性
E. 睑球结合膜粘连

正确答案：D。尼氏征阳性

解析：本题考查瘢痕性类天疱疮的临床表现。类天疱疮的病理改变为上皮完整，无棘层松解；形成上皮下疱，尼氏征阴性。尼氏征阳性（D错，为本题的正确答案）为天疱疮的临床表现。类天疱疮的口腔病损多发生在牙龈，最典型的表现呈剥脱性龈炎（C对）样损害。病损发生在口角区则因瘢痕粘连而致张口受限或小口畸形（B对）。眼部病损可出现睑球结合膜粘连（E对）。病损累及皮肤出现皮肤水疱（A对）。